26岁初孕妇，现妊娠40周，近半月头痛、眼花，今晨出现剧烈头痛并呕吐2次来院就诊。测血压180/110mmHg。为与慢性高血压鉴别，最有价值的血液检查结果是
A. 尿素值增高
B. 肌酸值增高
C. 肌酐值增高
D. 尿素氮值增高
E. 尿酸值增高

正确答案：E。尿酸值增高

解析：掌握“娠期高血压疾病”知识点。